具过氧桥结构，属于倍半萜内酯类的成分是
A. 青藤碱
B. 天麻素
C. 常山碱
D. 小檗碱
E. 青蒿素

正确答案：E。青蒿素

解析：本题考查的是青蒿素的分类。具过氧桥结构，属于倍半萜内酯类的成分是青蒿素（E对）。单环倍半萜青蒿素是从中药青蒿（黄花蒿）中分离得到的具有过氧结构的倍半萜内酯，有很好的抗恶性疟疾活性，其多种衍生物制剂己用于临床。青藤碱（A错），即青风藤碱，属于吗啡烷类生物碱。此类化合物具有部分饱和的菲核，罂粟中的吗啡、可待因也属此类。天麻素（B错），即天麻苷，属于酚苷。天麻苷为天麻中的镇静有效成分。酚苷是通过酚羟基而成的苷，如苯酚苷、萘酚苷、蒽醌苷、香豆素苷、黄酮苷、木脂体苷等。存在于柳树和杨树皮中的水杨苷也属此类。小檗碱（E错）属于原小檗碱类，多为季铵碱，如黄连、黄柏、三颗针中都存在小檗碱。常山碱（C错）的类别，2022年考试指南未明确说明。